壁胸膜
A. 前界体表投影与肺前界体投影基本一致
B. 下界比肺下界约低2肋
C. 覆盖于纵隔两侧，称纵隔胸膜
D. 包绕肺尖上方的部分，称胸膜顶
E. 以上都正确

正确答案：E。以上都正确

解析：壁胸膜前界体表投影与肺前界体投影基本一致（A对）。壁胸膜下界比肺下界约低2肋（B对）。壁胸膜覆盖于纵隔两侧，称纵隔胸膜（C对）。壁胸膜包绕肺尖上方的部分，称胸膜顶（D对，故E对为本题正确答案）。